患者，女，29岁。结婚4年未孕，月经38～50天一行，量少色淡，面色晦暗，腰酸腿软，性欲淡漠，舌淡，苔白滑，脉沉细。其中医治法是
A. 滋阴养血，调冲益精
B. 温肾助阳，化湿固精
C. 疏肝解郁，养血调经
D. 燥湿化痰，理气调经
E. 活血化瘀，调经助孕

正确答案：B。温肾助阳，化湿固精

解析：患者婚后未避孕而未受孕，属不孕症，月经后期，且量少色淡，面色晦暗，腰酸腿软，性欲淡漠，可判断患者为肾阳虚，又结合患者舌苔脉象，舌淡，苔白滑，脉沉细，符合肾阳虚的舌苔脉象，故治法为温肾助阳，化湿固精（B对）。肾阴虚证 证候∶婚久不孕，月经先期，量少或量多，色红无块，形体消瘦，腰酸，头目眩晕，耳鸣，五心烦热。舌红苔少，脉细数。治法∶滋阴养血，调冲益精（A错）。肝气郁结证 证候∶婚久不孕，经前乳房、小腹胀痛，月经周期先后不定，经血夹块，情志抑郁或急躁易怒，胸胁胀满。舌质暗红，脉弦。治法∶疏肝解郁，养血调经（C错）。